下颌骨的薄弱部位不包括
A. 正中联合
B. 颏孔区
C. 下颌角
D. 乙状切迹
E. 髁突颈部

正确答案：D。乙状切迹

解析：下颌骨在结构上存在易发生骨折的薄弱部位：①正中联合位置最突出，亦是胚胎发育时两侧下颌突的连接处；②颏孔区有颏孔，又有下颌前磨牙牙槽窝；③下颌角为下颌骨的转折处，骨质较薄，且有下颌第三磨牙牙槽窝位于其间；④髁突颈部较细小，其上下均较为粗大。掌握“下颌骨及腭骨解剖特点”知识点。